患者男，下颌双侧5678缺失，双侧下颌4余留牙正常，口底距舌侧龈缘的距离为4mm。如果设计铸造支架可摘局部义齿，设计RPI卡环组。大连接体可采用
A. 舌杆
B. 连续杆
C. 带连续杆的舌杆
D. 舌板
E. 唇杆

正确答案：D。舌板

解析：由于口底至舌侧龈缘过低而选用舌板。掌握“暂时冠及印模与模型”知识点。